能分泌抗体的细胞是
A. NK细胞
B. B细胞
C. 肥大细胞
D. 细胞毒性T淋巴细胞
E. 浆细胞

正确答案：E。浆细胞

解析：本题考查能分泌抗体的细胞。能分泌抗体的细胞是浆细胞（B对）, 又称抗体形成细胞（AFC），能分泌大量特异性抗体，是B细胞的分化的终末细胞。NK细胞（A错）来源于骨髓淋巴样干细胞，其不表达特异性抗原识别受体，而是通过表面活化性受体和抑制性受体对“自身”与“非己”进行识别，并直接杀伤某些肿瘤和病毒感染的靶细胞。B细胞（B错）由哺乳动物骨髓或禽类法氏囊中的淋巴样干细胞分化发育而来；成熟B细胞主要定居于外周淋巴器官的淋巴滤泡内，约占外周淋巴细胞总数的20%；B细胞表面的多种膜分子在其分化和功能执行中有重要作用；B细胞不仅能通过产生抗体发挥特异性体液免疫功能，同时也是重要的抗原提呈细胞，并参与免疫调节。肥大细胞（C错）主要分布于呼吸道、胃肠道和泌尿生殖的的黏膜上皮及皮肤下的结缔组织内靠近血管处，参与Ⅰ型超敏反应。细胞毒性T淋巴细胞（CTL）（D错）表达CD8，通常所指的CD8+T细胞即指CTL，主要功能是特异性识别内源性抗原肽-MCHⅠ类分子复合物，进而杀伤靶细胞。